男，47岁。交通事故导致右肘关节上方被车轮压伤2小时。剧痛、出血较多。查体：P96次/分，BP88/60mmHg，神志清楚，右肘窝伤口已加压包扎，敷料鲜血渗透，桡动脉搏动消失。该患者送入医院，进行处理时首先应
A. 指压法压迫患肢肱动脉止血
B. 用止血带绕扎上臂止血
C. 用细绳锁捆上臂止血
D. 静脉输入止血药
E. 再加压包扎伤口

正确答案：B。用止血带绕扎上臂止血

解析：患者桡动脉搏动消失，应考虑合并上肢大动脉损伤。患者右肘窝伤口已加压包扎，但敷料仍被鲜血渗透，说明包扎止血效果不好，还存在活动性出血。因此，患者送入医院后，首先应进行的处理是用止血带绕扎上臂止血（B对）。止血带止血一般用于四肢伤大出血，且加压包扎无法止血的情况。指压法压迫患肢肱动脉止血（A错）为应急措施，因四肢动脉有侧支循环，其效果有限，且难以持久。使用止血带时，严禁用细绳锁或电线等充当止血带（C错），因为细绳锁太细，加压时可对肌肉组织造成二次损伤。由于患者BP88/60mmHg，收缩压≤90mmHg，提示休克可能，应紧急进行物理手段止血，而静脉输入止血药（D错）为一般性治疗措施，起效慢，不适合该患者。患者加压包扎止血效果不佳，不应再次加压包扎伤口（E错）。